2型糖尿病伴轻、中度肾功能不全者适宜选用的降糖药是
A. 瑞格列奈
B. 格列美脲
C. 二甲双胍
D. 普萘洛尔
E. 格列喹酮

正确答案：E。格列喹酮

解析：本题考查降糖药的临床作用。格列喹酮（E对）适用于伴有肾功能不全的二型糖尿病患者。瑞格列奈（A错）既可降低空腹血糖，又可降低餐后血糖。格列美脲（B错）为磺酰脲类促胰岛素分泌药，用于食物、运动疗法及减轻体重均不能满意控制血糖的非胰岛素依赖型糖尿病。二甲双胍（C错）首选用于单纯饮食控制及体育锻炼治疗无效的2型糖尿病。普萘洛尔（D错）用于高血压、心绞痛、室上性快速心律失常、室性心律失常、心肌梗死。